采用标准差法对某3岁儿童进行体格评估和分类，其身高测量值处于同年龄、同性别儿童中位数减1～2个标准差之间，体重测量值低于同年龄、同性别儿童中位数减2个标准差。该儿童营养状况为
A. 正常
B. 低体重
C. 生长迟缓
D. 消瘦
E. 超重

正确答案：B。低体重

解析：本题考查儿童营养状况的相关内容。该儿童只有体重/年龄低于中位数减2个标准差，则为低体重（B对AE错）。儿童营养不良分别以体重/年龄、身长（身高）/年龄和体重/身长（身高）为评估指标，采用标准差法进行评估和分类，体重/年龄测量值低于中位数减2个标准差为低体重、身长(身高)/年龄测量值低于中位数减2个标准差为生长迟缓（C错），体重/身长（身高）测量值低于中位数减2个标准差为消瘦（D错）。